关于痈的叙述，下列哪一项不正确
A. 是邻近多个毛囊及所属皮脂腺、汗腺的急性化脓性感染
B. 可由单个疖扩展或多个疖融合而成
C. 金葡菌为主要致病菌
D. 好发于上下嘴唇等质地柔软部位
E. 在糖尿病等免疫力低下的成年病人中较为多见

正确答案：D。好发于上下嘴唇等质地柔软部位

解析：痈好发于皮肤厚韧的项部和背部，而不是上下嘴唇等质地柔软部位（D错，为本题正确答案）。痈是指多个相邻毛囊及其周围组织的急性化脓性感染（A对），或由多个疖融合而成（B对）；其致病菌多为金黄色葡萄球菌（C对）；常发生于抵抗力低下者，如糖尿病、肥胖、不良卫生习惯以及免疫缺陷状态等（E对）。